医学道德修养是指医务人员在医学道德方面所进行的自我教育，自我锻炼和自我陶冶，以及在此基础上达到的
A. 医学道德境界
B. 医疗实践能力
C. 医疗技术水平
D. 医患沟通能力
E. 医疗道德意识

正确答案：A。医学道德境界

解析：医德修养是指医务人员按照社会所倡导的医德理念及其规范，在医德实践中进行自我教育、自我评价、自我锻炼和自我陶冶的过程及其所达到的医学道德境界（A对）。